洗涤剂造成环境磷污染，引起水体富营养化的成分主要是
A. 助洗剂
B. 络合剂
C. 腐蚀抑制剂
D. 酶
E. 表面活性剂

正确答案：A。助洗剂

解析：本题考查洗涤剂造成环境磷污染，引起水体富营养化的成分。洗涤剂主要由表面活性剂和添加剂两部分组成，添加剂主要有助洗剂、络合剂、腐蚀抑制剂、抗菌剂和酶等。其中助洗剂（A对BCDE错）如磷酸盐、焦磷酸盐、三聚磷酸盐等，具有软化水、提高碱度、增强湿润能力和洗涤能力。这是冼涤剂造成环境磷污染、引起水体富营养化的主要原因。